下列关于非特异性感觉投射系统的叙述，正确的是
A. 投射至皮质特定区域，具有点对点关系
B. 投射至皮质，产生特定感觉
C. 投射至皮质广泛区域，维持皮质的兴奋性
D. 被切断时，动物保持清醒状态
E. 受刺激时，动物处于昏睡状态

正确答案：C。投射至皮质广泛区域，维持皮质的兴奋性